男性，40岁。近5个月来上腹胀痛，反酸，近3个月来反复呕吐，呕吐物为酸性宿食，按幽门梗阻内科治疗5天后缓解。幽门梗阻的原因可能为
A. 黏膜炎症、水肿
B. 溃疡愈合瘢痕形成
C. 复合型溃疡
D. 癌变
E. 胃外压性梗阻

正确答案：A。黏膜炎症、水肿

解析：青年男性患者，上腹胀痛、反酸、呕吐，呕吐物为酸性宿食，按幽门梗阻内科治疗后缓解，应考虑为消化性溃疡所致的炎症水肿性幽门梗阻（A对）。溃疡引起幽门梗阻有痉挛性、水肿性和瘢痕性三种，水肿性梗阻在经内科治疗待粘膜炎症、水肿消退后多可缓解。瘢痕性梗阻是由于溃疡反复发作、愈合后形成的，内科治疗不能缓解，需手术解除（B错）。复合型溃疡（C错）指胃和十二指肠均有活动性溃疡，确诊需要依靠X线钡餐检查或胃镜检查。消化性溃疡癌变（D错）所致的幽门梗阻、胃外压性梗阻（E错）经内科保守治疗多不能缓解。